某男，48岁。因口渴多饮、多食、多尿、腰膝酸次、四肢乏力等不适症状就诊，近2月来体重下降5kg，相关检查显示随机血糖15mmol/L，HbA₁c8.5%，临床诊断为2型糖尿病。HbA₁c是目前临床诊断糖尿病常用检测指标之一，其水平反映近2～3月的平均血糖水平，正常参考值应为
A. 3.5%～6%
B. 4%～6%
C. 5%～7.1%
D. 5%～7.8%
E. 5%～8%

正确答案：B。4%～6%

解析：本题考查的是糖化血红蛋白的参考值。HbA₁c是目前临床诊断糖尿病常用检测指标之一，其水平反映近2～3月的平均血糖水平，正常参考值应为4%～6%（B对）。糖化血红蛋白（HbA₁c）：糖化血红蛋白（GHb）是红细胞生存期间血红蛋白（HbA）与已糖缓慢、连续的非酶促反应产物，其中与葡萄糖结合的HbA₁c含量最高（60%～80%），是目前临床最常检测的部分；在血糖和尿糖波动较大时有特殊诊断价值。HbA₁c水平取决于血糖水平、高血糖持续时间，其代谢周期与红细胞寿命基本一致，故其水平反映近2～3个月的平均血糖水平。HbA₁c增高和降低均有临床意义。参考值：4%～6%。